小儿身高80cm，前囟门已闭，头围48cm，乳牙20枚，会跳并能用简单的语言表达自己的需要，对人事有喜乐之分。按公式计算此小儿的体重约是
A. 8Kg
B. 9Kg
C. 10Kg
D. 12Kg
E. 14Kg

正确答案：D。12Kg

解析：综合题目中条件大致可以估算出小儿约2岁，此阶段小儿一般体重为12kg（D对），8kg（A错）小儿大约8个月，9kg（B错）小儿约10个月，10kg（C错）小儿约1岁，14kg（E错）小儿约3岁。